对药物毒性反应叙述正确的是
A. 毒性药物不可避免
B. 与药物蓄积无关
C. 是一种较为严重的药物反应
D. 其发生与药物选择性低有关
E. 毒性反应一般不可预知

正确答案：C。是一种较为严重的药物反应

解析：药物的毒性反应是指在剂量过大的时候或者药物在体内蓄积过多（B错）的时候，发生的一种比较严重的药物反应（C对）。毒性反应一般是可以预知的（E错），且可以避免发生（A错）。